属于肾上腺素受体激动剂的降眼压药是
A. 毛果芸香碱
B. 甘露醇
C. 乙酰唑胺
D. 噻吗洛尔
E. 地匹福林

正确答案：E。地匹福林

解析：本题考查降低眼压药的分类。属于肾上腺素受体激动剂的降眼压药是地匹福林（E对）。肾上腺素受体激动剂降眼压药：地匹福林、溴莫尼定。毛果芸香碱（A错）为缩瞳药。甘露醇（B错）为高渗脱水剂。乙酰唑胺（C错）为碳酸酐酶抑制剂。噻吗洛尔（D错）为β受体阻断剂。